复方丹参片组方中的臣药是
A. 川芎
B. 冰片
C. 苏合香
D. 三七
E. 丹参

正确答案：D。三七

解析：本题考查复方丹参片的方义简释。复方丹参片组方中的臣药是三七（D对）。复方丹参片【方义简释】方中三七微苦泄散，甘补温通，善活血化瘀、通经止痛，兼补气血，故为臣药。丹参（E错）苦能泄散，微寒清凉，善活血化瘀、通脉止痛，故为君药。冰片（B错）辛散苦泄，香窜微寒，善通窍止痛、醒神化浊，并引药入心经，故为佐使药。全方配伍，辛香行散，共奏活血化瘀、理气止痛之功，故善治气滞血瘀所致的胸痹，症见胸闷、心前区刺痛；冠心病心绞痛属气滞血瘀者，用之亦佳。